生产环境中的气象条件主要指
A. 气温、气流 、气压、热辐射
B. 热辐射、气压、气流、气湿
C. 热辐射、气温、气湿 、气流
D. 气流、气温、 气湿、气压、热辐射
E. 气压、气流、气温、气湿

正确答案：C。热辐射、气温、气湿 、气流

解析：本题考查生产环境中的气象条件。生产环境中的气象条件主要指空气温度、湿度、风速和热辐射（C对ABDE错）。生产环境中的气温除取决于大气温度外，还受太阳辐射、工作热源和人体散热等因素影响；生产环境中的气湿以相对湿度表示；生产环境中的气流除受自然界风力的影响外，主要与厂房中的热源有关；任何具有温度的物体都可以电磁波的形式向外散发热量，称为热辐射，其形式主要是红外线及一部分可见光。